影响中药浸提效果的因素有
A. 浸提溶剂及用量
B. 浸提方法与新技术的应用
C. 浸提温度
D. 浸提时间
E. 浸提压力

正确答案：A、B、C、D、E。浸提溶剂及用量；浸提方法与新技术的应用；浸提温度；浸提时间；浸提压力

解析：本题考查影响浸提的因素。影响中药浸提效果的因素有浸提溶剂及用量（A对）、浸提方法与新技术的应用（B对）、浸提温度（C对）、浸提时间（D对）、浸提压力（E对）。影响浸提的因素：1.药材粒度；2.药材成分；3.浸提温度；4.浸提时间；5.浓度梯度；6.溶剂pH；7.浸提压力。